OR值是哪种流行病学研究方法的评价暴露与疾病关系的指标
A. 临床试验
B. 回顾性队列研究
C. 病例对照研究
D. 前瞻性队列研究
E. 社区试验

正确答案：C。病例对照研究